胃大部切除患者出现贫血，其主要原因是
A. HCl减少
B. 黏液减少
C. 内因子减少
D. HCO₃⁻减少
E. 胃蛋白酶活性减弱

正确答案：C。内因子减少